根据刑法相关规定，明知他人生产、销售、提供假药、劣药，而提供生产、经营场所、设备等便利条件的，以生产、销售、提供假药、劣药的共同犯罪论处。下列情形按生产、销售假药、劣药的共同犯罪论处的有
A. 明知他人销售假药、劣药，而为其提供发票的
B. 明知他人生产假药、劣药，而为其提供原料、辅料的
C. 明知他人生产假药、劣药，而为其提供网络销售渠道的
D. 明知他人销售假药、劣药，而为其提供广告宣传的

正确答案：A、B、C、D。明知他人销售假药、劣药，而为其提供发票的；明知他人生产假药、劣药，而为其提供原料、辅料的；明知他人生产假药、劣药，而为其提供网络销售渠道的；明知他人销售假药、劣药，而为其提供广告宣传的

解析：本题考查为生产、销售假、劣药品提供运输、保管、仓储等便利条件的主体应承担的法律责任。根据刑法相关规定，明知他人生产、销售、提供假药、劣药，而提供生产、经营场所、设备等便利条件的，以生产、销售、提供假药、劣药的共同犯罪论处。下列情形按生产、销售假药、劣药的共同犯罪论处的有明知他人销售假药、劣药，而为其提供发票的（A对）；明知他人生产假药、劣药，而为其提供原料、辅料的（B对）；明知他人生产假药、劣药，而为其提供网络销售渠道的（C对）；明知他人销售假药、劣药，而为其提供广告宣传的（D对）。为生产、销售假、劣药品提供运输、保管、仓储等便利条件的主体应承担的法律责任：根据《药品管理法》规定，知道或者应当知道属于假药、劣药或者124条第一款第一项至第五项的药品，而为其提供储存、运输等便利条件的，没收全部储存、运输收入，并处违法收入一倍以上五倍以下的罚款；情节严重的，并处违法收入五倍以上十五倍以下的罚款；违法收入不足五万元的，按五万元计算。该规定旨在发挥法律的威慑作用，打击与制售假劣药品有关的违法犯罪行为。根据最高人民法院、最高人民检察院《关于办理危害药品安全刑事案件适用法律若干问题的解释》第九条规定，明知他人生产、销售、提供假药、劣药，而提供生产、经营场所、设备或者运输、储存、保管、邮寄、网络销售渠道等便利条件的，以生产、销售、提供假药、劣药的共同犯罪论处。以生产、销售、提供假药、劣药的共同犯罪论处的情形还包括：明知他人生产、销售、提供假药、劣药，而提供资金、贷款、账号、发票、证明、许可证件的；或者提供生产技术或者原料、辅料、包装材料、标签、说明书的；或者提供虚假药物非临床研究报告、药物临床试验报告及相关材料的；或者提供广告宣传；或者提供其他帮助的。共同犯罪的，对各共同犯罪人合计判处的罚金应当在生产、销售假药、劣药金额的二倍以上。